下列方剂中不含滑石、甘草的是
A. 六一散
B. 碧玉散
C. 逍遥散
D. 蒿芩清胆汤
E. 小蓟饮子

正确答案：C。逍遥散

解析：逍遥散（C错，为本题正确答案）组成为甘草、当归、茯苓、芍药、白术、柴胡（逍遥散用归芍柴，苓术甘草姜薄偕，疏肝养血兼理脾，丹栀加入热能排）。六一散（A对）组成为滑石、甘草；碧玉散（B对）组成为滑石、甘草、青黛；蒿芩清胆汤（D对）组成为青蒿、竹茹、半夏、赤茯苓、青子芩、枳壳、陈皮、滑石、青黛、甘草；小蓟饮子（E对）组成为生地、小蓟、滑石、木通、蒲黄、藕节、淡竹叶、当归、山栀子、甘草。